女，45岁。2周前发热、咳嗽、咳黄痰、胸闷、胸痛、经抗炎治疗好转。现再次高热，咳嗽无痰，感胸闷。查体：T38.5℃，P115次/分，R25次/分，气管明显左移、右肺语颤减弱、叩诊呈实音、呼吸音消失，血WBC22×10⁹/L，N0.89。该患者首先考虑的诊断是
A. 肺脓肿
B. 肺炎链球菌肺炎
C. 阻塞性肺炎
D. 脓胸
E. 肺不张

正确答案：D。脓胸

解析：患者为中年女性，2周前有发热、咳嗽、咳黄痰、胸闷、胸痛的病史，经抗炎治疗后好转，现再次高热，咳嗽无痰，感胸闷，气管明显左移，叩诊呈实音，呼吸音消失，血WBC22×10⁹/L（正常4～10×10⁹/L），N0.89（正常为0.50～0.75），提示存在感染，根据其临床表现和辅助检查，考虑诊断为脓胸（D对）（患者2周前有肺炎的病史，现出现胸腔积液的症状跟体征，且有感染的征象，故考虑为脓胸）。肺脓肿（P58）（A错）主要表现为发热、咳嗽、咳脓臭痰。肺炎链球菌肺炎（P46）（B错）发病前多有上呼吸道感染症状，主要表现为寒战、高热、咳铁锈色痰，肺部叩诊浊音，触觉语颤增强并可闻及支气管呼吸音。阻塞性肺炎（C错）主要表现为咳嗽、咳痰、气短和呼吸困难。肺不张（E错）主要表现为呼吸困难、发绀、血压下降、心动过速等，仅在合并感染时，才出现发热等症状。